急性淋巴细胞白血病治疗首选
A. 甲氨蝶呤
B. 阿霉素
C. DA方案
D. 环磷酰胺
E. VP方案

正确答案：E。VP方案

解析：急性淋巴细胞白血病治疗首选VP方案（E对）（长春新碱+泼尼松），VP方案是其基础用药。甲氨喋呤（P575）（A错）是中枢神经系统白血病预防和治疗的首选药；DA方案（柔红霉素+阿糖胞苷）（P576）（C错）是急性髓系白血病（除急性早幼粒细胞白血病外）的首选治疗方案；阿霉素（B错）可用于淋巴瘤的联合化疗；环磷酰胺（P575）（D错）可用于急、慢性淋巴细胞白血病的治疗。